用紫外分光光度法测定吸光度时，进行空白校正的目的是
A. 消除药物中的杂质对测定结果的影响
B. 消除溶剂和吸收池对测定结果的影响
C. 消除温度对测定结果的影响
D. 消除非单色光对测定结果的影响
E. 消除仪器的波动对测定结果的影响

正确答案：B。消除溶剂和吸收池对测定结果的影响